以下哪项不是牙体缺损修复中增加修复体抗力的措施为
A. 使用优良材料
B. 避免应力集中
C. 增加牙尖斜度
D. 避免铸件缺陷
E. 金瓷冠的金瓷衔接区远离（牙合）接触点

正确答案：C。增加牙尖斜度

解析：本题考查牙体缺损修复中增加修复体抗力的措施。增加牙尖斜度（C错，为本题的正确答案）会使修复体受到较大的侧向力和咬合压力，导致应力集中，增加修复体折裂的危险，故应避免应力集中（B对）。金瓷冠的金瓷衔接区应远离（牙合）接触点（E对），此处是应力集中区，否则容易绷瓷或折裂。也应避免铸件缺陷（D对），否则会降低修复体的抗力，容易折断。使用优良材料（A对）可以提高修复体的机械性能，增加抗力。